办公场所是指
A. 管理或专业技术人员从事各种社会活动的临时性生活、工作环境。
B. 管理或专业技术人员从事各种社会活动的固定生活、工作环境。
C. 固定人群从事各种社会活动的临时性生活、工作环境。
D. 管理或专业技术人员处理（或办理）某种特定事务的室外工作环境。
E. 管理或专业技术人员处理（或办理）某种特定事务的室内工作环境。

正确答案：E。管理或专业技术人员处理（或办理）某种特定事务的室内工作环境。

解析：本题考查办公场所。办公场所是指管理或专业技术人员处理（或办理）某种特定事务的室内工作环境。如公职人员、商务职员和企事业单位专业技术或管理人员履行职责的办公环境。